下列关于多肽链的说法错误的是
A. 多肽链中有自由氨基的一端称为氨基末端（N-末端）
B. 多肽链中有自由羧基的一端称为羧基末端（C-末端）
C. 每条多肽链中氨基酸残基顺序编号都从N-端开始
D. C-端在左，N-端在右
E. 命名短肽从N-末端开始指向C-末端

正确答案：D。C-端在左，N-端在右

解析：多肽链中有自由氨基的一端称为氨基末端（N-末端）；有自由羧基的一端称为羧基末端（C-末端）；每条多肽链中氨基酸顺序编号都是从N-端开始；N-端在左，C-端在右；命名短肽从N-末端开始指向C-末端。掌握“氨基酸与多肽及蛋白质结构”知识点。